男性，62岁。近3个月来逐渐出现上腹不适，进食后饱胀，嗳气，纤维胃镜发现大弯侧胃壁上1cm大小块状肿物，与周围组织界限较为清楚，病理提示恶性。该肿瘤Borrmann分型
A. Ⅰ型
B. Ⅱ型
C. Ⅲ型
D. Ⅳ型
E. Ⅴ型

正确答案：A。Ⅰ型

解析：老年男性患者，因上腹不适，进食后饱胀、嗳气来诊，纤维胃镜见大弯侧胃壁上lcm大小的块状肿物，与周围组织界限较为清楚，病理提示恶性。进展期胃癌按Borrmann分型法可分为四型：I型（息肉型，也叫肿块型）：为边界清楚突入胃腔的块状癌灶；Ⅱ型（溃疡局限型）：为边界清楚并略隆起的溃疡状癌灶；Ⅲ型（溃疡浸润型）：为边界模糊不清的溃疡，癌灶向周围浸润；Ⅳ型（弥漫浸润型）：癌肿沿胃壁各层全周性浸润生长，边界不清。该患者的表现与BorrmannⅠ型相符（A对）。